尊重病人的人格，保守有关病人的秘密是
A. 执业药师职业道德准则
B. 执业药师执业行为规范
C. 执业药师履行的职责
D. 执业药师行使的权力
E. 执业药师应尽的义务

正确答案：E。执业药师应尽的义务